与其它抗凝药相比，凝血因子Xa直接抑制剂具有的药理作用特点包括
A. 作用直接、选择性高
B. 血浆半衰期较长
C. 治疗窗宽，无需监测INR
D. 肾功能不全者使用后出血风险低
E. 抗凝作用强且不影响已形成的凝血酶活性

正确答案：A、B、C、D、E。作用直接、选择性高；血浆半衰期较长；治疗窗宽，无需监测INR；肾功能不全者使用后出血风险低；抗凝作用强且不影响已形成的凝血酶活性

解析：本题考查凝血因子Xa直接抑制剂的药理作用。凝血因子Xa位于内、外源性凝血途径的交汇点，故直接抑制凝血因子Xa，凝血作用直接、选择性高（A对）。由于凝血因子Xa主要催化II因子向IIa因子转化，故抑制凝血因子Xa对已形成的凝血酶无影响（E对）。由于凝血因子Xa对肾脏的依赖性小，故肾功能不全者使用后出血风险低（D对）。此外，凝血因子Xa的优点还有血浆半衰期较长（B对）、治疗窗宽，无需监测INR（C对）。